环境流行病学研究的暴露因素主要是
A. 物理因素
B. 化学因素
C. 生物因素
D. 理化因素
E. 有害因素

正确答案：B。化学因素

解析：本题考查环境流行病学研究的暴露因素。环境流行病学研究的暴露因素主要是化学因素（B对ACDE错）。化学因素指环境中的化学物质，包括有机物、无机物、重金属、放射性物质等，它们可通过空气、水、土壤等媒介进入人体，对人体健康产生不利影响。